《国际卫生条例（2005）》主要针对的是
A. 药品的规格与剂型
B. 可引起国际关注的公共卫生风险
C. 可引起国际关注的多种慢性病
D. 可引起国际关注的多种精神病
E. 食品的包装与准入

正确答案：B。可引起国际关注的公共卫生风险

解析：《国际卫生条例（2005）》第二条：本条例的目的和范围是以针对公共卫生危害、同时又避免对国际交通和贸易造成不必要干扰的适当方式预防、抵御和控制疾病的国际传播，并提供公共卫生应对措施。因此，《国际卫生条例（2005）》主要针对的是可引起国际关注的公共卫生风险（B对）。